男，43岁，长期咳嗽，经常咳脓痰15年，发热、咳脓臭痰1周来诊。查体：左肺下背部呼吸音弱，可闻湿啰音。确诊首选下列哪项检查
A. 胸X线片
B. 胸CT
C. 纤维支气管镜
D. 痰细菌培养+药敏
E. 以上都不必做

正确答案：B。胸CT

解析：中年男性患者，咳嗽、咳脓痰15年（支扩的典型临床表现），近日发热、咳脓臭痰（提示有感染），查体：左肺下背部呼吸音弱，可闻湿啰音（提示左下肺炎），根据患者的病史、临床症状及体征，考虑诊断可能为支气管扩张症，继发感染，确诊首选胸CT（B对），HRCT可在横断面上清楚地显示扩张的支气管，肺炎在胸部CT上也有明显的表现，且兼具无创易重复易接受的特点。胸X线片（A错）该检查对判断有无支气管扩张缺乏特异性，病变轻时影像学检查可正常。纤维支气管镜（C错）只有当支气管扩张呈局灶性且位于段支气管以上时，才可发现弹坑样改变。痰细菌培养+药敏（D错）主要用于指导抗菌药物的选择，而不是确诊首选检查。